男，25岁。发热、腹泻、呕吐2天，大便黄稀水样，每日10余次，量多。粪常规：白细胞0～1/HP，血常规：WBC5.2×10⁹/L。该患者腹泻的主要原因是
A. 直肠刺激
B. 肠黏膜分泌增加
C. 结肠蠕动增强
D. 肠腔渗透压增高
E. 肠粘膜渗出增加

正确答案：B。肠黏膜分泌增加

解析：腹泻的原因包括渗出性腹泻、渗透性腹泻、分泌性腹泻及动力异常性腹泻。该患者为青年男性，腹泻、呕吐2天，大便黄稀水样，量多，血常规检查示WBC正常，符合肠黏膜分泌增加（B对）导致腹泻（分泌性腹泻）的特点：①每日大便量＞1L（可多达10L）；②大便为水样，无脓血；③禁食48小时后腹泻仍持续存在。直肠刺激（A错）可导致腹泻，但有里急后重及排便不尽感，每次排便量不多。结肠蠕动增强（C错）导致的腹泻（动力异常性腹泻）特点是排便急，粪便不带渗出物或血液，往往伴有肠鸣音亢进或腹痛。肠腔渗透压增高（D错）导致的腹泻（渗透性腹泻）特点是禁食后48小时腹泻停止或显著减轻。肠黏膜渗出增加（E错）导致的腹泻（渗出性腹泻）特点是粪便含有渗出液和血液。